中脑内有
A. 展神经核
B. 孤束核
C. 红核
D. 面神经核
E. 无

正确答案：C。红核

解析：红核（C对）位于中脑上丘高度的被盖中央部；展神经核（A错）位于脑桥；孤束核（B错）位于延髓内界沟外侧；面神经核（D错）位于脑桥下部。